以下属于评价筛查试验本身的真实性的—组指标是
A. 特异度、标准差
B. 灵敏度、特异度
C. 灵敏度、变异系数
D. 约登指数、预测值
E. 正确指数、变异系数

正确答案：B。灵敏度、特异度

解析：诊断试验的评价指标有：灵敏度和特异度（B对）、阳性预测值和阴性预测值、ROC曲线。